可加强肩关节囊上壁的是
A. 前臂骨间膜
B. 黄韧带
C. 前纵韧帮
D. 喙肩韧带
E. 喙肱韧带

正确答案：E。喙肱韧带

解析：喙肱韧带（E对）加强关节囊上壁。前纵韧带（C错）是位于椎体前面，防止椎体过伸。前臂骨间膜（A错）是位于肱骨和尺骨之间的骨膜，参与前臂运动。 黄韧带（B错）位于椎管内，连结相邻两椎弓板间的韧带，喙间韧带（D错）位于肩关节上方，不能加强肩关节关节囊上壁。